在临床试验中，不能将其作为研究对象的人是
A. 能从试验中受益的人
B. 具备某病特征的老年人和孕妇
C. 依从性好的人
D. 某种欲研究疾病的患者
E. 住院病人

正确答案：B。具备某病特征的老年人和孕妇